含有三氮唑结构，通过抑制芳香酶，用于乳腺癌治疗的药物是
A. 来曲唑
B. 枸橼酸他莫昔芬
C. 氟尿嘧啶
D. 氟他胺
E. 氟康唑

正确答案：A。来曲唑

解析：本题考查来曲唑的结构和药理作用。来曲唑（A对）通过抑制芳香酶，能有效抑制雄激素向雌激素转化，使雌激素水平下降，从而消除雌激素对肿瘤生长的刺激作用。